可以迅速缓解哮喘症状，起效快的药品是
A. 吸入型糖皮质激素
B. 非甾体抗炎药
C. β受体阻断剂
D. 短效β₂受体激动剂
E. 白三烯受体阻断剂

正确答案：D。短效β₂受体激动剂

解析：本题考查短效β₂受体激动剂。可以迅速缓解哮喘症状，起效快的药品是短效β₂受体激动剂（D对）类药物。短效β₂受体激动剂通常在数分钟内起效，适用于迅速缓解轻、中度哮喘急性症状，也可用于运动性哮喘。吸入型糖皮质激素（A错）为控制呼吸道炎症的预防性用药，起效缓慢且需连续和规律地应用2日以上方能充分发挥作用。连续用药4周才能出现疗效的药品是白三烯受体阻断剂（E错），因白三烯受体阻断剂的起效缓慢，作用较弱相当于色甘酸钠，一般连续应用4周后才能见疗效，且有蓄积性，仅适用于轻、中度哮喘和稳定期的控制，或合用以减少糖皮质激素和β₂受体激动剂的剂量。